男，18岁，学生。咳嗽3周，少量咯血2天，无发热。查体未见异常。胸部X线片示右下叶背段不规则片状影，可见薄壁空洞，血WBC8.5×10⁹/L，N0.80，Hb110g/L，PLT225×10⁹/L。为明确诊断，应首选的检查是
A. 支气管镜
B. 痰真菌培养
C. 痰涂片找抗酸杆菌
D. PPD试验
E. 血沉

正确答案：C。痰涂片找抗酸杆菌

解析：青少年男性患者，咳嗽3周（咳嗽咳痰2周以上是肺结核的常见可疑症状），少量咯血2天（多数肺结核患者有少量咯血），胸部X线片示：右下叶背段不规则片状影（肺结核常见病变部位为上叶尖后段、下叶背段和后基底段），可见薄壁空洞（肺结核易形成空洞和播散病灶），血WBC8.5×10⁹/L（WBC正常值：（4.0～10.0）×10⁹/L）， N0.80（N正常值：0.40～0.75）， Hb110g/L（成年男性Hb正常值：120～160g/L）， PLT225×10⁹/L（PLT正常值：（100～300）×10⁹/L），综合患者的病史、体征、X线及实验室检查，可诊断为肺结核，为明确诊断，应首选痰涂片找抗酸杆菌（C对）（痰中检出抗酸杆菌对诊断肺结核有极重要的意义）。支气管镜（A错）检查常应用于支气管结核和淋巴结支气管瘘的诊断；痰真菌培养（B错）主要用于真菌感染的肺部疾病的诊断；PPD试验（D错）可用于检出结核分枝杆菌的感染，但不能检出结核病；血沉（E错）可用于观察结核病的病情变化，但不能用于明确结核病的诊断。